书写中枢在优势半球的
A. 额中回后部
B. 额下回后部
C. 角回
D. 中央前回手区
E. 缘上回

正确答案：A。额中回后部

解析：书写中枢在优势半球的额中回后部（A对），该中枢主管书写功能，损伤后可出现手部有运动功能但写字、绘图等精细动作发生障碍，称为失写症。额下回后部（B错）为运动性语言中枢所在位置，该中枢主司说话功能，损伤后出现病人能发音却不能说出具有意义的语言，称运动性失语症。角回（C错）、缘上回（E错）为Wernicke区的组成部分，与理解别人的语言及文字密切相关，损伤后可出现感觉性失语症。中央前回为第Ⅰ躯体运动区所在位置，与管理全身骨骼肌运动相关，其中中央前回手区（D错）支配手部肌肉运动，损伤后可出现手部瘫痪，与书写中枢损伤后所致的手部可运动但不能进行精细动作相比，有一定区别。